健康状况综合评价中，需要使用加权法的是
A. 各指标相互有联系
B. 各指标存在拮抗作用
C. 各指标的作用相互独立
D. 各指标存在协同作用
E. 各指标存在因果关系

正确答案：C。各指标的作用相互独立

解析：本题考查健康状况综合评价的相关内容。健康状况综合评价中，各指标的作用相互独立（C对ABDE错）需要使用加权法。